风寒闭肺作喘的主要症状是
A. 喘咳气涌，胸部胀痛，痰黏色黄，脉滑数
B. 喘咳气逆，恶寒发热，痰稀无汗，脉浮紧
C. 喘咳气逆，倚息难卧，痰稀声微，脉沉细
D. 喘息胸痛，咽喉发紧，喉中痰鸣，脉弦
E. 喘咳胸闷，咳嗽痰多，呕恶纳呆，脉滑

正确答案：B。喘咳气逆，恶寒发热，痰稀无汗，脉浮紧

解析：本题考查的是喘证的辨证论治。风寒闭肺作喘的主要症状是喘咳气逆，恶寒发热，痰稀无汗，脉浮紧（B对）。喘即气喘、喘息。喘证是以呼吸困难，甚至张口抬肩、鼻翼扇动、不能平卧为特征的疾病。西医学的肺炎、支气管炎、肺气肿、肺源性心脏病、心源性哮喘以及癔病等发生呼吸困难时，可参考此内容辨证论治。（一）风寒闭肺证：【症状】喘咳气逆，呼吸急促，胸部胀闷，痰多色白稀薄而带泡沫，兼头痛鼻塞、无汗、恶寒、发热，舌苔薄白而滑，脉浮紧。（二）痰热壅肺证：【症状】喘咳气涌，胸部胀痛，痰稠黏色黄，或夹血痰，伴胸中烦闷、身热、有汗、口渴喜冷饮、咽干、面红、尿赤、便秘。舌质红，苔薄黄腻，脉滑数（A错）。（三）痰浊阻肺证：【症状】喘而胸满闷塞，甚则胸盈仰息，咳嗽，痰多黏腻色白，咳吐不利，兼有呕恶，食少，口黏不渴。舌苔白腻，脉滑（E错）或濡。（四）肾不纳气证：【症状】喘促日久，动则喘甚，呼多吸少，气不得续，小便常因咳甚而失禁，或尿后余沥，形瘦神疲，汗出肢冷，面唇青紫，或有跗肿，舌淡苔薄，脉沉弱；或见喘咳，面红烦躁，口咽干燥，足冷，汗出如油。舌红少津，脉细数。症状为喘咳气逆，倚息难卧，痰稀声微，脉沉细（C错）、喘息胸痛，咽喉发紧，喉中痰鸣，脉弦（D错）的病证，2022年考试指南未明确说明。